可引起首关消除的主要给药途径是
A. 吸入给药
B. 舌下给药
C. 口服给药
D. 直肠给药
E. 皮下注射

正确答案：C。口服给药

解析：口服药物（C对）在胃肠道吸收入血，通过门静脉系统进入肝脏，进行一系列的代谢，导致进入全身血液循环的有效药物量明显减少（这种作用称为首关消除）。吸入给药（A错）可用于呼吸道局部（如气雾剂治疗哮喘）或直接由肺吸收而进入体循环，不经过消化道吸收入血液，不是引起首关消除的主要给药途径。舌下含服（B错）时，药物由血流丰富的口腔黏膜吸收，直接进入全身循环，可在很大程度上避免首过消除。直肠给药（D错）时，直肠中上、下段毛细血管血液流入下痔静脉和中痔静脉，然后进入下腔静脉，期间不经过肝脏。皮下注射（E错）给药可通过毛细血管壁被吸收，药物分子能顺利通过较大的细胞间隙，吸收完全而且速度较快，可避免首过消除现象。